目前临床上根管再治疗的诊间封药，常用的药物为氢氧化钙和
A. 医用酒精
B. 乙醚
C. 2%氯己定
D. 0.1%碘酊
E. 甲醛甲酚

正确答案：C。2%氯己定

解析：根管再治疗的患牙，在根管充填前需进行诊间封药。目前临床上常用的药物为氢氧化钙和2%氯己定。掌握“根管再治疗”知识点。